铝箔包装内止咳颗粒的灭菌宜选用
A. 紫外线灭菌法
B. 滤过除菌法
C. 热压灭菌法
D. 辐射灭菌法
E. 干热空气灭菌法

正确答案：D。辐射灭菌法

解析：本题考查灭菌方法。铝箔包装内止咳颗粒的灭菌宜选用辐射灭菌法（D对）。辐射灭菌法：以放射性同位素（⁶⁰Co或¹³⁷Cs）放射的γ射线杀菌的方法。辐射灭菌的特点是不升高灭菌产品的温度，穿透性强，适合于不耐热药物的灭菌。医疗器械、容器、生产辅助用品、不受辐射破坏的原料药及成品等均可用本法灭菌。包装材料也可用本法灭菌，从而大大减少了污染的机会。紫外线灭菌法（A错）：紫外线灭菌法是指用紫外线照射杀灭微生物的方法。本法适用于物品表面的灭菌、无菌室空气及蒸馏水的灭菌；不适用于药液和固体物质深部的灭菌；普通玻璃容器可吸收紫外线，因此装于其中的药物不能用此法灭菌。滤过除菌法（B错）：系利用细菌不能通过致密具孔滤材的原理以除去气体或液体中微生物的方法，是一种机械除菌的方法，这种机械叫除菌过滤器。常用于气体、热不稳定药品溶液或原料的除菌。热压灭菌法（C错）：是采用高压饱和水蒸气加热杀灭微生物的方法。此法具有很强的灭菌效果，灭菌可靠，能杀灭所有细菌繁殖体和芽胞，是在制剂生产中应用最广泛的一种灭菌方法。凡能耐高压蒸汽的药物制剂、玻璃容器、金属容器、瓷器、橡胶塞、膜过滤器等均能采用此法。干热灭菌法：干热灭菌法是指在干热环境中灭菌的方法，包括火焰灭菌法和干热空气灭菌法（E错）。此法适用于耐高温但不宜用湿热灭菌法灭菌的物品灭菌，如玻璃器具、金属制容器、纤维制品、固体试药、液状石蜡等均可采用本法灭菌。缺点是穿透力弱，温度不易均匀，而且灭菌温度较高，灭菌时间较长，不适于橡胶、塑料及大部分药品的灭菌。